夏季，于某装有集中式空调的宾馆住宿的团体人群中，数天内相继出现了一种主要症状为发热、咳嗽及肺部炎症的疾病。以后的病因学调查认为与空调系统污染有关。该病菌主要存在于空调的
A. 回风管道
B. 风机
C. 过滤系统
D. 冷却塔水
E. 新风管道

正确答案：D。冷却塔水

解析：本题考查军团菌的滋生地。从病因学调查的结果来看，空调系统污染是导致军团菌出现的原因，而冷却塔水是空调系统中的一个重要组成部分，它的作用是将热量从空调系统中转移出去，因此，冷却塔水（D对ABCE错）很可能是军团菌的滋生地。